下列各项，不属妊娠病范畴的是
A. 恶阻
B. 胞转
C. 儿枕痛
D. 胞阻
E. 子冒

正确答案：C。儿枕痛

解析：产妇在产褥期内，发生与分娩或产褥有关的小腹疼痛，称为产后腹痛，其中因瘀血引起者，称儿枕痛，属产后病（C错，为本题正确答案）。常见妊娠病有：恶阻（阻病）（A对）、妊娠腹痛（胞阻）（D对）、子痫（子冒）（E对）、妊娠小便不通（胞转）（B对）。